第一类精神药品处方保存期限为
A. 1年
B. 2年
C. 3年
D. 4年
E. 5年

正确答案：C。3年

解析：麻醉药品和第一类精神药品处方保存期限为3年（C对）。普通处方、急诊处方、儿科处方保存期限为1年，医疗用毒性药品、第二类精神药品处方保存期限为2年。